“刚脏”指的脏是
A. 肝
B. 心
C. 脾
D. 肺
E. 肾

正确答案：A。肝

解析：肝在五行属木，木性曲直，故肝气具有柔和和舒展畅达之能；肝气疏泄，畅达全身气机，性喜舒畅而恶抑郁；肝内寄相火，主升主动。以上皆反应了肝为刚脏的生理特性。（A对）。心（B错）为“君主之官”。脾（C错）“后天之本”、“气血生化之源”。肺（D错）为“相傅之官”。肾（E错）“先天之本”。